2020年1月31日，药品零售企业甲从药品批发企业乙购进药品上市许可持有人丙生产的中药注射剂Z。在验收入库时核对验明票、货、账三者一致后入库销售。中药注射制剂Z说明书标注标注“有效期24个月”，标签标注“生产日期为2017月1日，有效期至2021年6月”。2020年6月甲所在地突降暴雨，中药注射剂Z被雨水浸泡导致药品标签剥落或字迹模糊。2020年7月甲将该批药品中的三盒销售给某患者销售总价为200元。该患者用药后病情加重。该患者可以向甲请求赔偿损失，此外还可以请求支付赔偿金。关于赔偿金额的正确的是
A. 赔偿金不得少于200元
B. 赔偿金不得少于600元
C. 赔偿金不得少于800元
D. 赔偿金不得少于1000元

正确答案：D。赔偿金不得少于1000元

解析：本题考查药品质量侵权的法律责任。2020年1月31日，药品零售企业甲从药品批发企业乙购进药品上市许可持有人丙生产的中药注射剂Z。在验收入库时核对验明票、货、账三者一致后入库销售。中药注射制剂Z说明书标注标注“有效期24个月”，标签标注“生产日期为2017月1日，有效期至2021年6月”。2020年6月甲所在地突降暴雨，中药注射剂Z被雨水浸泡导致药品标签剥落或字迹模糊。2020年7月甲将该批药品中的三盒销售给某患者销售总价为200元。该患者用药后病情加重。该患者可以向甲请求赔偿损失，此外还可以请求支付赔偿金。关于赔偿金额的正确的是赔偿金不得少于1000元（D对）。根据《药品管理法》第144条第2款规定，因药品质量间题受到损害的，受害人可以向药品上市许可持有人、药品生产企业请求赔偿损失，也可以向药品经营企业、医疗机构请求赔偿损失。接到受害人赔偿请求的，应当实行首负责任制，先行赔付；先行赔付后，可以依法追偿。另外，对生产假劣药或者明知假劣药仍销售使用的，受害人可以要求惩罚性赔偿等。根据《药品管理法》第144条第三款规定，生产假药、劣药或者明知是假药、劣药仍然销售、使用的，受害人或者其近亲属除请求赔偿损失外，还可以请求支付价款十倍或者损失三倍的赔偿金；增加赔偿的金额不足一千元的，为一千元。